患者，女，28岁。产后20天，左乳房肿痛，伴发热恶寒，口干，舌红苔薄黄，脉浮数。查体：左乳外上象限可扪及一硬块，皮肤微红压痛。诊断为急性乳腺炎，治疗应首选青霉素加
A. 瓜蒌牛蒡汤
B. 透脓散
C. 四妙散
D. 黄连解毒汤
E. 仙方活命饮

正确答案：A。瓜蒌牛蒡汤

解析：患者初产妇，诊断为急性乳腺炎，左乳外上象限可扪及硬块，皮肤表面微红压痛，且伴发症状属热证。中医证型为乳痈，气滞热壅证。治疗疏肝清胃，通乳消肿。方药：瓜蒌牛蒡汤加减（A对）。透脓散功用清热解毒，托里透脓，治疗乳痈热毒炽盛证。常见症状乳房肿痛加剧，皮肤焮红灼热，肿块变软，有应指感。或溃后脓出不畅，红肿热痛不消，身热不退，有传囊现象；舌红，苔黄腻，脉洪数（B错）。四妙散清热利湿，舒筋壮骨，治疗湿热痿证。常见症状两足麻木，痿软，肿痛（C错）。黄连解毒汤泻火解毒，治疗三焦火毒证。常见症状：大热烦躁，口燥咽干，错语不眠；或热病吐血、衄血；或热甚发斑；或身热下利，或湿热黄疸；或外科痈疡疔毒。小便黄赤，舌红苔黄，脉数有力（D错）。仙方活命饮清热解毒，消肿溃坚，活血止痛，治疗阳证痈疡肿毒初起。常见症状：红肿焮痛，或身热凛寒，苔薄黄或白，脉数有力（E错）。